在病例对照研究中，如选用现患病例做研究对象，最常见的偏倚是
A. 回忆偏倚
B. 失访偏倚
C. 入院率偏倚
D. 检出偏倚
E. 现患-新发病例偏倚

正确答案：E。现患-新发病例偏倚